特异性菌斑学说主要观点
A. 牙周病的发生是口腔菌群混合感染所致
B. 牙周破坏是由于细菌数量增加，毒力增强所致
C. 不同类型、不同部位的牙周破坏与特异性细菌有关
D. 牙周破坏是因为病变部位的防御能力低下
E. 以上都是

正确答案：C。不同类型、不同部位的牙周破坏与特异性细菌有关

解析：本题考查特异性菌斑学说的主要观点。特异性菌斑学说认为：在牙周健康区与病损区、不同类型牙周病的病损区之间，绝大多数细菌是口腔正常菌丛，仅少数具毒力和能损害宿主防御功能的特异致病菌，才对牙周病的发生发展起关键作用（C对）。牙周病的发生是口腔菌群混合感染所致是非特异性菌斑学说（A错）。牙周破坏是由于细菌数量增加，毒力增强所致是菌群失调学说（B错）。